妇女子宫脱垂，属于
A. 脾气虚
B. 脾阳虚
C. 中气下陷
D. 寒湿困脾
E. 湿热蕴脾

正确答案：C。中气下陷

解析：脾虚中气不振，气陷于下，即中气下陷，冲任不固，带脉失约，无力提系则子宫下垂（C对）。脾气虚证会出现食少、腹胀、便溏与气虚症状共见，无脏器脱垂现象（A错）。脾阳虚会有食少、腹胀腹痛、便溏与虚寒症状共见，无脏器脱垂现象（B错）。寒湿困脾证会有纳呆、腹胀、便溏、身重与寒湿症状共见，无脏器脱垂现象（D错）。湿热蕴脾证会有腹胀、纳呆、便溏、身重与寒湿症状共见，无脏器脱垂现象（E错）。